患儿，7岁。两足趾、足背皮肤有10余枚隆起赘生物，小者如粟米，大者如黄豆，状如花蕊，表面蓬松枯槁，搔破后易出血。其诊断是
A. 传染性软疣
B. 寻常疣
C. 掌跖疣
D. 丝状疣
E. 扁平疣

正确答案：B。寻常疣

解析：题目该患儿两足趾、足背皮肤有10余枚隆起赘生物符合寻常疣，小者如粟米，大者如黄豆，状如花蕊，表面蓬松枯槁，搔破后易出血可诊断为寻常疣（B对）。传染性软疣相当于中医的鼠乳。多见于儿童。皮损为半球形丘疹，米粒到黄豆、豌豆大小；中央有脐凹，表面有蜡样光泽，挑破顶端可挤压出白色乳酪样物质；数目不定，数个到数十个不等，呈散在性或簇集性分布，但不相互融合。好发于躯干和面部。有轻度传染性，愈后不留疤痕，可自行消失（A错）。掌跖疣相当于中医的跖疣。好发生在手掌、足底或指〔趾)间。皮损为角化性丘疹，中央稍凹，外周有稍带黄色高起的角质环，除去表面角质后，或见疏松的白色乳头状角质物，掐或挑破后易出血，数目多时可融合成片。有明显的压痛，用手挤压则疼痛加剧。常在外伤部位发生，足部多汗者易生本病（C错）。丝状疣,丘疹，针头、米粒到黄豆大小，呈淡红色、褐色或正常皮肤颜色。数目很多，散在分布，或簇集成群，有的互相融合，常因搔抓沿表皮剥蚀处发生而形成一串新的损害。好发于颜面部和手背。一般无自觉症状，偶有瘙痒感，有时可自行消退，但也可复发（E错）。